地高辛引起的药源性疾病
A. 急性肾衰竭
B. 横纹肌溶解
C. 中毒性表皮坏死
D. 心律失常
E. 听力障碍

正确答案：D。心律失常

解析：本题考查药源性疾病。地高辛属于强心苷类会引起心律失常（D对）；环孢素可以引起急性肾衰竭（A错）；他汀类最明显的不良反应就是横纹肌溶解（B错）；引起中毒性表皮坏死（C错）的药物有磺胺类、抗惊厥药、别嘌醇、非留体抗炎药等；引起药源性耳聋与听力障碍（E错）的药物有氨基糖苷类、非甾体抗炎药、高效利尿药等。